患者男性,突然腰腹胀痛,疼痛向外阴部放射，尿频，尿急，尿黄赤，舌暗红，有瘀斑，脉弦，诊断为尿石证，宜选用
A. 三金排石汤
B. 金铃子散加石韦散加减
C. 小蓟饮子
D. 八正散
E. 济生肾气丸

正确答案：B。金铃子散加石韦散加减

解析：患者男性,突然腰腹胀痛,疼痛向外阴部放射，尿频，尿急，尿黄赤可诊断为尿石症；舌暗红，有瘀斑，脉弦为气血瘀滞证之象。治法：理气活血，通淋排石。方药：金铃子散合石韦散加减（B对）。